某女，42岁。自初潮即发倒经，平日胸闷不舒，心烦急躁，口干口苦，尿黄，每至行经，必见鼻血。一周前，又见口黏，肝区胀痛，目珠轻度黄染，确诊为胆囊炎。就诊时又适值经期，每日鼻血。据此，医师在方中处以郁金。此因其除能活血止痛，行气解郁外，又能
A. 清热解毒，凉血清心
B. 消积化滞，通腑泄热
C. 消积化滞，泻下通便
D. 利胆退黄，凉血清心
E. 清热解毒，泻下通便

正确答案：D。利胆退黄，凉血清心

解析：本题考查的是郁金的功效。郁金除能活血止痛，行气解郁外，又能利胆退黄，凉血清心（D对）。郁金：【功效】活血止痛，行气解郁，凉血清心，利胆退黄。虎杖：【功效】利湿退黄，清热解毒，活血祛瘀，化痰止咳，泻下通便（E错）。功效为清热解毒，凉血清心（A错）、消积化滞，通腑泄热（B错）或消积化滞，泻下通便（C错）的中药，2022年考试指南未明确说明。